治疗潮热盗汗，遗精腰酸者，常应用熟地黄、山茱萸等，亦可选用
A. 黄芩
B. 黄连
C. 黄柏
D. 苦参
E. 龙胆草

正确答案：C。黄柏

解析：黄柏主入肾经，善泻相火，退骨蒸，治阴虚火旺，骨蒸潮热、遗精盗汗（C对）。黄芩（A错）用于湿温暑湿，胸闷呕恶，泻痢，黄疸，肺热咳嗽，血热出血，胎动不安。黄连（B错）用于湿热痞满，呕吐，泻痢，血热吐衄，胃火牙痛，目赤肿痛，口舌生疮。苦参（D错）用于湿热泻痢，便血，黄疸，赤白带下，湿疹湿疮，皮肤瘙痒，湿热淋痛，尿闭不通。龙胆草（E错）用于湿热黄疸，带下，肝火头痛，目赤肿痛，胁痛口苦，惊风抽搐。